关于研究质量的论述，不正确的是
A. 研究质量越高，则内部真实性越高
B. 研究质量越高，则病因推论的正确性越高
C. 偏倚控制措施越充分，则研究质量越高
D. 样本量越大，则研究质量越高
E. 对研究质量而言，研究设计的重要性大于更具体的偏倚控制措施

正确答案：D。样本量越大，则研究质量越高

解析：本题考查研究质量的相关内容。研究质量是对研究偏倚控制程度的总体衡量。因此，研究质量决定研究结果的真实性，质量越高，偏倚就越小，结果的真实性就越高（A对），结论正确的可能性就越大（B对）。研究的质量由研究的偏倚控制措施决定，偏倚控制措施越充分，则研究质量越高（C对）。对研究质量而言，研究设计的重要性大于更具体的偏倚控制措施（E对）。关于研究的质量并不是样本量越大越好（D错，为本题正确答案），样本量决定抽样误差的大小，决定结果估计的精确性。